女，50岁。3个月来发作性头晕、头痛，伴面色苍白，心悸，冷汗。共发作3次，每次持续20分钟到2小时，发作时测血压180～210/110～130mmHg，平时血压正常。查体：BP120/90mmHg，体型偏瘦，皮肤微潮，心率90次/分，律齐，四肢末梢凉。该患者首先考虑的诊断是
A. 原发性高血压
B. 原发性醛固酮增多症
C. 嗜铬细胞瘤
D. 甲状腺功能亢进
E. 围绝经期综合征

正确答案：C。嗜铬细胞瘤

解析：中年女性患者，发作性头晕、头痛伴面色苍白、心悸、冷汗，发作时间20分钟到2小时，发作时血压180～210/110～130mmHg，平时血压正常（嗜铬细胞瘤典型临床表现），故该患者首先考虑诊断为嗜铬细胞瘤（C对）。原发性高血压（A错）多为持续性高血压，非阵发性。原发性醛固酮增多症（B错）的典型表现为高血压与低钾血症，随病情发展血压渐高而非阵发性（P703）。甲状腺功能亢进（D错）主要表现为烦躁失眠、心悸、乏力、多汗怕热等，其收缩压可升高，但舒张压下降，脉压升高（P681）。围绝经期综合征（E错）最典型的症状是潮热、月经改变，一般无阵发性高血压。